下列哪项不属于生产环境职业有害因素控制措施
A. 从卫生和安全角度设计生产工艺和设备
B. 降低劳动强度，减少接触时间
C. 正确选择厂址、合理安排车间布局
D. 避免使用有毒物质
E. 密闭、隔离、通风，车间整洁，安全贮运

正确答案：B。降低劳动强度，减少接触时间

解析：本题考查生产环境职业有害因素控制措施。降低劳动强度，减少接触时间（B错，为本题正确答案）不属于生产环境职业有害因素控制措施，可应用先进的技术和工艺，尽可能采取遥控或程序控制，最大限度地减少操作者接触毒物的机会。从卫生和安全角度设计生产工艺和设备（A对）；正确选择厂址、合理安排车间布局（C对）；避免使用有毒物质（D对）；密闭、隔离、通风，车间整洁，安全贮运（E对）均属于生产环境职业有害因素控制措施。